成人心肺复苏的合理顺序是
A. 胸外按压-人工呼吸-开放气道
B. 开放气道-胸外按压-人工呼吸
C. 开放气道-人工呼吸-胸外按压
D. 人工呼吸-胸外按压-开放气道
E. 胸外按压-开放气道-人工呼吸

正确答案：E。胸外按压-开放气道-人工呼吸

解析：根据2010年AHA复苏指南，成人心肺复苏的顺序为C-A-B，即在现场复苏时，成人心肺复苏的合理顺序是胸外按压-开放气道-人工呼吸（E对）。